不按规定使用麻醉药品、精神药物、情节严重的，由卫生行政部门给予的处理是
A. 暂停职业活动三个月至六个月
B. 暂停职业活动六个月至一年
C. 给予行政处分
D. 吊销医师职业证书
E. 追究刑事责任

正确答案：D。吊销医师职业证书

解析：《执业医师法》规定，医师在执业活动中，不按照规定使用麻醉药品、医疗用毒性药品、精神药品和放射性药品的，由县级以上人民政府卫生行政部门给予警告或者责令暂停6个月以上1年以下执业活动（AB错）；情节严重的，吊销医师执业证书（D对）；构成犯罪的，依法追究刑事责任（E错）。